下列有关生长发育遵循的一般规律，不正确的描述是
A. 由下到上
B. 由近到远
C. 由粗到细
D. 由低级到高级
E. 由简单到复杂

正确答案：A。由下到上

解析：生长发育一般遵循的一般规律：由上到下、由近到远、由粗到细、由低级到高级、由简单到复杂的规律。掌握“小儿生长发育规律”知识点。